石棉肺的病理特点是
A. 小结节
B. 团块纤维化
C. 大结节
D. 弥漫性纤维化

正确答案：D。弥漫性纤维化

解析：本题考查石棉肺的病理特点。石棉肺是在生产过程中长期吸入石棉粉尘所引起的以肺组织弥漫性纤维化为主的疾病。其特点是全肺弥漫性纤维化（D对ABC错），是弥漫性纤维化型尘肺的典型代表，不出现或极少出现结节性损害。石棉肺是硅酸盐尘肺中最常见、危害最严重的一种。